过量服用会发生血尿的中药
A. 麻黄
B. 肉桂
C. 黄芪
D. 石斛
E. 人参

正确答案：B。肉桂

解析：本题考查的是引起中药不良反应发生的因素。过量服用会发生血尿的中药肉桂（B对）。剂量过大可能会引起不良反应：中药的剂量使用范围比较大，在常规剂量下，发生不良反应的机会较少，但不可为强调疗效而随意加大用药剂量。处方中某些药物剂量的增减，很可能改变原方剂的功效和主治。大多数中药不良反应的发生，都与超剂量使用有关，如肉桂过量会发生血尿，麻黄（A错）过量出现心率加快、血压升高、心律失常等。黄芪、石斛与人参（CDE）过量使用的不良反应，2022年考试指南未明确说明。